天疱疮可发生于下列部位，除外
A. 皮肤
B. 口腔
C. 食道黏膜
D. 腹股沟
E. 指甲

正确答案：E。指甲

解析：天疱疮主要累及皮肤、口腔、食道黏膜，皮肤病损长出现于前胸、躯干以及头皮、颈、腋窝、腹股沟等易受摩擦处。掌握“天疱疮”知识点。